甘遂除泻水逐饮外，又能
A. 消肿散结
B. 清肝杀虫
C. 杀虫疗癣
D. 解毒止血
E. 祛痰止咳

正确答案：A。消肿散结

解析：本题考查的是甘遂的功效。甘遂除泻水逐饮外，又能消肿散结（A对）。甘遂：【功效】泻水逐饮，消肿散结。芦荟：【功效】泻下，清肝，杀虫（B错）。川楝子：【功效】行气止痛，杀虫，疗癣（C错）。大黄：【功效】泻下攻积，清热泻火，解毒止血（D错），活血祛瘀。芫花：【功效】泻水逐饮，祛痰止咳（E错）。外用杀虫疗疮。